下列化合物中，按碱性强弱排列正确的是
A. 季铵碱＞脂肪杂环碱＞酰胺＞芳香胺
B. 脂肪杂环碱＞季铵碱＞酰胺＞芳香胺
C. 脂肪杂环碱＞季铵碱＞芳香胺＞酰胺
D. 季铵碱＞脂肪胺＞芳香胺＞酰胺
E. 脂肪胺＞芳香胺＞酰胺＞季铵碱

正确答案：D。季铵碱＞脂肪胺＞芳香胺＞酰胺

解析：本题考查的是生物碱碱性的大小。下列化合物中，按碱性强弱排列正确的是季铵碱＞脂肪胺＞芳香胺＞酰胺（D对）。根据pKₐ值大小，可将生物碱分为：①强碱（pKₐ＞11），如季铵碱、胍类生物碱；②中强碱（pKₐ7～11），如脂胺、脂杂环类生物碱；③弱碱（pKₐ2～7），如芳香胺、N-六元芳杂环类生物碱；④极弱碱（pKₐ＜2），如酰胺、N-五元芳杂环类生物碱。